延髓与脑桥在外形上的分界标志是
A. 髓纹
B. 界沟
C. 延髓脑桥沟
D. 延髓脑桥沟和界沟
E. 延髓脑桥沟和髓纹

正确答案：E。延髓脑桥沟和髓纹

解析：延髓与脑桥在外形上的分界标志是延髓脑桥沟（腹侧）和髓纹（背侧）（E对）。